疱疹性口炎心火上炎证的中医治法是
A. 疏风清热
B. 清热解毒
C. 清心泻火
D. 滋阴降火
E. 引火归原

正确答案：C。清心泻火

解析：心火上炎证候舌上、舌边溃烂，色赤疼痛，烦躁多啼，口干欲饮，小便短黄，舌尖红，苔薄黄，脉数，指纹紫滞。治法：清心凉血，泻火解毒。方药：泻心导赤散加减（C对）。风热乘脾证疏风清热，泻火解毒（AB错）。虚火上炎证宜滋阴降火，引火归原（DE错）。